根据《药品经营质量管理规范实施细则》，关于药品经营企业人员要求的说法，正确的是
A. 药品批发企业从事药品验收人员，应当具有大专（含）以上药学学历
B. 跨地域连锁经营的药品零售连锁企业质量管理工作负责人应是执业药师
C. 药品经营企业从事质量管理的人员可为兼职人员
D. 药品零售连锁企业从事质量管理、验收养护等工作的专职人员应不少于职工总数的4%
E. 药品零售企业从事质量管理的人员，每年应接受省级药品监督管理部门组织的继续教育

正确答案：B。跨地域连锁经营的药品零售连锁企业质量管理工作负责人应是执业药师

解析：本题考查药品经营管理。根据《药品经营质量管理规范实施细则》，跨地域连锁经营的药品零售连锁企业质量管理工作负责人应是执业药师（B对）。